脱敏牙膏有效成份
A. 20%二氧化硅
B. 氟化亚锡
C. 0.321%氟化钠
D. 中草药成分
E. 三氯羟苯醚

正确答案：B。氟化亚锡

解析：抗牙本质敏感牙膏的有效成分主要有两种：①以可溶性钾盐为主，但是此类牙膏使用时间过长会使痛觉神经麻木，以致延误口腔内的其他疾病的发现和治疗；②牙本质小管堵塞剂，常见成分有氟化亚锡或其他锡盐类、乙酸锶、Novamin、磷硅酸钙钠和精氨酸等。掌握“自我口腔保健方法”知识点。